治疗闭经时，应按照哪项原则
A. 虚者补之，实者泻之
B. 补气养血，益经之源
C. 活血逐瘀，以通为先
D. 补益肝肾，以培根本
E. 先攻后补，或先补后攻

正确答案：A。虚者补之，实者泻之

解析：闭经的治疗原则应根据病证，虚者补而通之，实者泻而通之（A对），虚实夹杂当补中有通，攻中有养。切不可不分虚实概以活血理气通之。特别是虚者因血海空虚、源断无血可泻，若一改泻而通之必会伤及脏腑、气血、经络，适得其反。只有通过补益之法，使气血恢复，脏腑平衡，血海充盛，则经自行。若因病而致经闭，又当先治原发疾病，待病愈则经可复行；经仍未复潮者，再辨证治之。